关于脱水药的适应症，错误的是
A. 慢性心功能不全
B. 青光眼
C. 脑水肿
D. 急性肾功能衰竭
E. 肾间质水肿

正确答案：A。慢性心功能不全

解析：脱水药临床应用-甘露醇、山梨醇：脑水肿、青光眼、急性肾衰竭（减轻肾间质水肿）；高渗葡萄糖：脑水肿、青光眼（A对）。